初次应答最主要的特点是
A. IgG大量产生
B. IgG产生的快
C. IgG和IgM同时产生
D. IgM产生的快
E. lgG的亲和力强

正确答案：D。IgM产生的快